有关鼓室6个壁的名称，错误的是
A. 上壁为盖壁
B. 下壁为颈静脉壁
C. 前壁为颈动脉壁
D. 后壁为迷路壁
E. 内侧壁为迷路壁

正确答案：D。后壁为迷路壁

解析：鼓室由6个壁组成，分别上壁为盖壁（A对），下壁为颈静脉壁（B对），前壁为颈动脉壁（C对），后壁为乳突壁（D错，为本题正确答案），内侧壁为迷路壁（E对）。